月经后3～7天，下列哪项检查或治疗不适当
A. 取子宫内膜检查，确定是否有分泌期改变
B. 放置节育器
C. 腹腔镜
D. 剖腹探查术
E. 子宫输卵管造影术

正确答案：A。取子宫内膜检查，确定是否有分泌期改变

解析：月经后3～7天和月经第5～6天，不是同一个时期，月经后3～7天已经是月经周期的9～13天了。此时，子宫内膜是增生期。而且不是这个时期也不是子宫内膜不规则脱落取内膜检查的时期。掌握“功能失调性子宫出血”知识点。